以躯干、四肢等大腿肌肉群参与为主的，有节律，时间较长，能够维持在一个稳定状态的身体活动称为
A. 阻力活动
B. 体适能
C. 协调性活动
D. 无氧运动
E. 有氧运动

正确答案：E。有氧运动

解析：以躯干、四肢等大腿肌肉群参与为主的，有节律、时间较长，能够维持在一个稳定状态的身体活动称为有氧运动（E对）。无氧运动（D错）是指以无氧代谢为主要功能途径的身体活动形式，一般为肌肉的强力收缩活动。体适能（B错）是指人们拥有或获得的、与完成身体活动能力相关的一族要素或特征。抗阻力活动（A错）是指肌肉对抗阻力用力时的重复运动，主要依赖无氧代谢供能，其中也包括有氧代谢供能的成分。协调性活动（C错）是指改善人体平衡和协调性的组合活动。